菌痢流行间歇期间的重要传染源是
A. 急性期病人
B. 轻症病人
C. 重症病人
D. 急性恢复期病人
E. 慢性病人和带菌者

正确答案：E。慢性病人和带菌者

解析：菌痢的传染源主要为急性、慢性菌痢病人及带菌者。慢性菌痢病情迁延不愈，排菌量虽然较少，但持续时间长，提示慢性菌痢患者有长期储存病原体的作用，而且在春季复发较多，对这个阶段维持流行过程起了重要作用。掌握“细菌性痢疾”知识点。